牙周炎时引起牙齿松动的因素不包括
A. 牙槽骨吸收
B. 咬合创伤
C. 牙周韧带急性炎症
D. 牙周袋形成
E. A+B+C+D

正确答案：D。牙周袋形成

解析：本题考查牙周炎时引起牙齿松动的因素。牙周袋形成（D错，为本题的正确答案）只是说明发生了附着丧失，此时如果牙周支持组织破坏不大，仍然不会引起牙齿的松动。牙周炎时引起牙齿松动的因素主要包括牙槽骨吸收（A对）、咬合创伤（B对）、牙周韧带急性炎症（C对）及其他牙周支持结构的破坏。